在两位数标记法的牙位纪录中，54代表
A. 右上第一前磨牙
B. 右上第一乳磨牙
C. 左下第一双尖牙
D. 左下第一乳磨牙
E. 左上第一前磨牙

正确答案：B。右上第一乳磨牙

解析：本题考查临床牙位记录法-国际牙科联合会系统。口腔流行病学调查时常采用两位数标记法表示各乳牙，即每颗乳牙由两个阿拉伯数字组成。第一个数字代表该牙所在的区域，口腔内上、下、左、右共4个区：右上区为5、左上区为6、左下为7、右下为8；第二个数字代表该牙在区域中的位置，由乳中切牙至第二乳磨牙分别为1、2、3、4、5。因此54代表右上第一乳磨牙（B对）。右上第一前磨牙为恒牙，记为14（A错）。左下第一双尖牙为恒牙，记为34（C错）。左下第一乳磨牙记为74（D错）。左上第一前磨牙为恒牙，记为24（E错）。同理，1234分别代表恒牙区的：右上，左上，左下，右下区。